西维因属于下列哪一类农药
A. 有机磷类
B. 拟除虫菊酯
C. 氨基甲酸酯
D. 有机氯类

正确答案：C。氨基甲酸酯

解析：本题考查西维因的种类。氨基甲酸酯（C对ABD错）是氨基甲酸的N位上被甲基或其他基团取代酯类。因速效、内吸、触杀、残留期短及对人畜毒性较有机磷低的优点，被广泛使用。常用的有呋喃丹、西维因、速灭威等。